蛋白质合成后经化学修饰的氨基酸是
A. 酪氨酸
B. 半胱氨酸
C. 蛋（甲硫）氨酸
D. 丝氨酸
E. 羟脯氨酸

正确答案：E。羟脯氨酸

解析：本题考查蛋白质合成后经化学修饰的氨基酸。蛋白质合成后经化学修饰的氨基酸是羟脯氨酸（E对）。酪氨酸（A错）、半胱氨酸（B错）、蛋（甲硫）氨酸（C错）、丝氨酸（D错）均属于生物体直接用于合成蛋白质的氨基酸。